属于HMG-CoA还原酶抑制剂，有内酯结构，属于前药，水解开环后有3，5-二羟基羧酸的是
A. 普伐他汀
B. 氟伐他汀
C. 阿托伐他汀
D. 瑞舒伐他汀
E. 辛伐他汀

正确答案：E。辛伐他汀

解析：本题考查他汀类药物。辛伐他汀（E对）属于HMG-CoA还原酶抑制剂，有内酯结构，属于前药。普伐他汀（A错）、氟伐他汀（B错）、阿托伐他汀（C错）、瑞舒伐他汀（D错）均不是前药。